50岁男性，咳嗽伴声音嘶哑3个月，右锁骨上窝触及一个肿大的淋巴结，质硬无压痛。提示该患者的诊断是
A. 喉炎
B. 肺癌
C. 胃癌
D. 鼻咽癌
E. 肺结核

正确答案：B。肺癌

解析：患者老年男性，咳嗽伴声音嘶哑3个月，右锁骨上窝触及一个肿大的淋巴结，质硬无压痛，首先考虑诊断肺癌。咳嗽为气管受压引起，声音嘶哑为喉返神经受压引起，右锁骨上窝有肿瘤的淋巴结转移。故答案选B。喉炎、肺结核通常不会出现锁骨上窝的淋巴结肿大；胃癌的淋巴结转移可出现在左锁骨上窝（Virehow淋巴结）。鼻咽癌多表现为鼻出血、鼻塞、耳鸣、复视、头痛等，少见咳嗽声嘶。故选B。掌握“肺癌”知识点。